听觉感受器位于
A. 壶腹嵴
B. 椭圆囊
C. 基底膜
D. 螺旋膜
E. 以上均不是

正确答案：D。螺旋膜

解析：螺旋膜上（D对）有螺旋器，是听觉感受器。壶腹嵴（A错）是位觉感受器。椭圆囊（B错）上有椭圆囊斑，是位觉感受器。螺旋膜又称基底膜，故本题CD均对。